男性，69岁。间断上腹痛10余年，2月来加重伴饱胀，体重下降7kg，Hb90g/L，最可能的诊断是
A. 慢性胰腺炎
B. 慢性肝炎
C. 胃癌
D. 消化性溃疡
E. 功能性消化不良

正确答案：C。胃癌

解析：老年男性患者，有10余年上腹痛病史（考虑慢性胃炎或消化性溃疡），2月来腹痛加重伴饱胀（上腹痛规律改变），体重下降、Hb90g/L（中度贫血，男性正常值为120～160g/L），提示有恶病质表现。综合该患者病史与实验室检查，考虑诊断为胃癌（C对）。慢性胰腺炎（P436）（A错）患者腹痛常因饮酒、饱食或高脂食物诱发，平卧位时加重，前倾坐位、弯腰、侧卧蜷曲时疼痛减轻，可放射至背部或前胸，无体重下降与贫血。慢性肝炎（B错）多见于30～50岁男性，常见症状是乏力、食欲下降、肝区隐痛，无体重减轻。消化性溃疡（P359）（D错）常表现为与进食有关的节律性腹痛，无体重下降与贫血。功能性消化不良（P384）（E错）无器质性病变，主要表现为餐后饱胀、早饱感、上腹灼烧感、嗳气、食欲不振、恶心等，无体重下降与贫血。